特异质反应是指
A. 少数病人对某些药物特别敏感
B. 反应性质与常人相同
C. 药物固有的药理作用不一致
D. 药理性拮抗药救治无效
E. 与先天遗传异常无关

正确答案：A。少数病人对某些药物特别敏感

解析：特异质反应：少数特异体质病人对某些药物反应特别敏感，反应性质也可能与常人不同，但与药物固有的药理作用基本一致，反应严重程度与剂量成比例，药理性拮抗药救治可能有效。这种反应是一类先天遗传异常所致的反应，例如，对骨骼肌松弛药琥珀胆碱发生的特异质反应是由于先天性血浆胆碱酯酶缺乏所致。掌握“药物不良反应”知识点。